依照《关于禁止商业贿赂行为的暂行规定》，属于商业贿赂行为的包括
A. 经营者在商品交易中向对方单位或其个人附赠现金
B. 经营者在商品交易中向对方单位或其个人附赠物品
C. 经营者销售商品时在账外暗中以现金退给对方单位或个人一定比例的商品价款
D. 经营者在商品交易中向对方单位或个人赠送小额广告礼品
E. 经营者为购买者以报销各种费用等方式，给付对方单位或个人财物

正确答案：A、B、C、E。经营者在商品交易中向对方单位或其个人附赠现金；经营者在商品交易中向对方单位或其个人附赠物品；经营者销售商品时在账外暗中以现金退给对方单位或个人一定比例的商品价款；经营者为购买者以报销各种费用等方式，给付对方单位或个人财物

解析：本题考查商业贿赂行为。依照《关于禁止商业贿赂行为的暂行规定》，属于商业贿赂行为的包括经营者在商品交易中向对方单位或其个人附赠现金（A对）；经营者在商品交易中向对方单位或其个人附赠物品（B对）；经营者销售商品时在账外暗中以现金退给对方单位或个人一定比例的商品价款（C对）；经营者为购买者以报销各种费用等方式，给付对方单位或个人财物（E对）。《关于禁止商业贿赂行为的暂行规定》第二条：经营者不得违反《反不正当竞争法》第八条规定，采用商业贿赂手段销售或者购买商品。本规定所称商业贿赂，是指经营者为销售或者购买商品而采用财物或者其他手段贿赂对方单位或者个人的行为。前款所称财物，是指现金和实物，包括经营者为销售或者购买商品，假借促销费、宣传费、赞助费、科研费、劳务费、咨询费、佣金等名义，或者以报销各种费用等方式，给付对方单位或者个人的财物。第二款所称其他手段，是指提供国内外各种名义的旅游、考察等给付财物以外的其他利益的手段。